复面洞制备时阶梯的髓壁与
A. 龈壁平行
B. 龈壁垂直
C. 轴壁平行
D. 近中壁平行
E. 远中壁平行

正确答案：A。龈壁平行

解析：本题考查窝洞的结构。复合洞制备时，制备成阶梯结构不仅有利于保护牙髓，同时可以使颌面洞的髓壁与邻面洞的龈壁同时承担咀嚼压力，增强患牙的抗力作用。阶梯结构颌面的髓壁与牙体长轴垂直，邻面洞的龈壁与牙体长轴垂直，所以阶梯结构的髓壁与龈壁平行（A对B错）。阶梯结构的髓壁与轴壁垂直（C错）。阶梯结构的髓壁与近中壁垂直（D错），与远中壁垂直（E错）。